下列哪项是确诊妊娠期病毒性肝炎的根据
A. 蛋白尿和水肿
B. 皮肤瘙痒和黄疸
C. 妊娠晚期上腹部疼痛，吐咖啡样物
D. 黄疸昏迷
E. 血中谷丙转氨酶增高，HBsAg阳性

正确答案：E。血中谷丙转氨酶增高，HBsAg阳性